心房颤动
A. 第一心音增强
B. 心率小于脉率
C. 心室律绝对不规则
D. 心尖部3/6级收缩期杂音
E. 开瓣音

正确答案：C。心室律绝对不规则

解析：心房颤动（P188）时心房率一般为350～600次/分，心房无序的颤动即失去了有效的收缩和舒张，心房泵血功能恶化或丧失，加之房室结对快速心房激动的递减传导，引起心室不规则的反应，即心室律绝对不规则（C对）。当心室率过快时，心室收缩期时间缩短，心室搏动过弱，以致未能开启主动脉瓣，或因动脉血压波太小，未能传导至外周动脉，可发生脉搏短绌（心率大于脉率）（B错）。第一心音增强（九版诊断学P150）（A错）常见于二尖瓣狭窄，也可见于心肌收缩力增强和心动过速，如高热、贫血等。房颤时第一心音强度变化不定。心尖部3/6级收缩期杂音（D错）主要见于风湿性心瓣膜病二尖瓣关闭不全等（九版诊断学P157）。开瓣音（九版诊断学P153）（E错）又称二尖瓣开放拍击声，常位于第二心音后，见于二尖瓣狭窄而瓣膜尚柔软时，开瓣音的存在可作为二尖瓣瓣叶弹性及活动尚好的间接指标。